女，49岁。接触性出血10个月，妇科检查发现：宫颈有4cm×4cm菜花状肿物，累计阴道上2/3，周围无盆腔浸润。该患者最应该行的治疗是
A. 子宫全切术
B. 宫颈锥切术
C. 子宫切除术及盆腔淋巴结清扫术
D. 放疗
E. 手术加放疗

正确答案：C。子宫切除术及盆腔淋巴结清扫术

解析：该患者为中老年女性，接触性出血10个月。妇检：宫颈有4cm×4cm菜花状肿物，累计阴道上2/3，周围无盆腔浸润（ⅡA1肿瘤侵犯阴道上2/3，无明显宫旁浸润，临床可见癌灶≤4cm），应诊断为子宫颈癌ⅡA1期。对于子宫颈癌ⅡA1期，治疗选择行广泛性子宫切除术及盆腔淋巴结清扫术（C对）。子宫全切术（P308）（A错）适用于ⅠA1期。宫颈锥切术（P303）（B错）适用于阴道镜检查不满意的CINⅡ和所有CINⅢ。放疗（D错）、手术加放疗（P308）（E错）适用于不宜单纯手术治疗的恶性肿瘤。